患者，女，38岁。结婚3年，夫妇同居未孕，月经先后不定期，经行乳房胀痛，善太息，舌淡红苔薄白，脉弦细。其证候是
A. 肝肾阴虚
B. 肝郁脾虚
C. 肝阳上亢
D. 肝郁
E. 气滞血瘀

正确答案：D。肝郁

解析：患者月经先后不定期，并伴有经行乳房胀痛，善太息是肝郁气滞，经脉不利，郁气欲舒；舌淡苔红薄白，脉弦细是肝郁气滞之象（D对）。肝肾阴虚以腰酸胁痛、眩晕、耳鸣、遗精等为主要表现的虚热证候（A错）。肝郁脾虚证以胁胀作痛、情志抑郁、腹胀、便溏等为主要表现的证候（B错）。肝阳上亢证以眩晕耳鸣、头目胀痛、面红、烦躁、腰膝酸软等为主要表现的证候（C错）。气滞血瘀证临床以身体局部胀闷走窜疼痛，甚或刺痛，疼痛固定、拒按；或有肿块坚硬，局部青紫肿胀；或有情志抑郁，性急易怒；或有面色紫黯，皮肤青筋暴露，妇女可见经闭或痛经，经色紫黯或夹血块，或乳房胀痛，舌质紫黯或有斑点，脉弦涩等为辩证依据（E错）。